一患者左侧面颊因交通外伤，当时采用药敷，一天后揭开发现伤至骨面，并伴有活动性出血。创面检查不用检查哪里
A. 颊神经
B. 面神经
C. 骨面
D. 腮腺导管
E. 舌神经

正确答案：E。舌神经

解析：本题主要考查口腔颌面部损伤。面颊部外伤，创面检查不用检查舌神经（E错，为本题正确答案）。口腔颌面部损伤可伴有其他解剖结构的损伤：口腔颌面部有唾液腺、面神经及三叉神经分布，如腮腺（D对）受损，可并发涎瘘；如损伤面神经（B对），可发生面瘫；颧骨颧弓骨折可引起眼球和视神经损伤；而三叉神经损伤时则可在相应分布区域出现麻木感（AC对）。